反映诊断试验可靠性的指标是
A. 灵敏度
B. 特异度
C. 约登指数
D. 阳性似然比
E. 符合率

正确答案：E。符合率

解析：本题考查反映诊断试验可靠性的指标。符合率（E对ABCD错）是反映诊断试验可靠性的指标。此外还有标准差、变异系数、相关系数、kappa值等。